不适用于连枷胸的处理措施是
A. 气管插管吸痰，给氧辅助呼吸
B. 浮动胸壁牵引
C. 胸壁加压，包扎固定
D. 胸腔镜骨折固定
E. 开胸骨折固定

正确答案：C。胸壁加压，包扎固定

解析：连枷胸即多根多处肋骨骨折，主要表现为反常呼吸（即吸气时肋骨骨折软化区胸壁内陷，呼气时外突），其主要处理原则为有效镇痛和呼吸管理，包括对呼吸道分泌物潴留、呼吸功能障碍的患者行气管插管吸痰、给氧辅助呼吸（A对）；浮动胸壁牵引（B对），以消除胸壁反常呼吸运动；长期胸壁浮动且不能摆脱辅助呼吸机者，可采用胸腔镜骨折固定（D对）或开胸骨折固定（E对）等。胸壁加压，包扎固定（C错，为本题正确答案）主要用于闭合性单处肋骨骨折的治疗。